作为机体获得对HBV免疫力及乙型肝炎患者痊愈的指标是
A. HbsAg（+）
B. 抗-HBs（+）
C. HBeAg（+）
D. 抗-HBc（+）
E. 抗-HBe（+）

正确答案：B。抗-HBs（+）

解析：作为机体获得对HBV免疫力及乙型肝炎患者痊愈的指标是抗-HBs（+）（B对），抗HBs是一种保护性抗体，在急性感染后期出现，可持续数年。HBsAg（+）（A错）见于无症状的乙型肝炎携带者和慢性乙型肝炎患者。HBeAg（+）（C错）表明患者处于高感染低应答期。抗-HBc（+）（D错）提示乙型肝炎急性期或慢性肝炎急性发作。抗-HBe（+）（E错）提示病毒复制多处于静止状态，传染性降低。